眶下孔的体表投影为
A. 鼻尖至眼内角连线的中点
B. 鼻尖至眼外角连线的中点
C. 鼻翼至耳屏连线的中点
D. 鼻尖至耳屏连线的中点
E. 以上叙述均不正确

正确答案：B。鼻尖至眼外角连线的中点

解析：眶下孔：位于眶下缘中点下约0.5cm处。眶下孔的体表定位：位于眶下缘中点以下，相当于鼻尖至眼外角连线的中点。颏孔的体表定位：位于下颌骨体的外侧面，正对下颌第一、二前磨牙间的下方。腮腺导管的体表定位：位于颧弓下方约1cm处，耳垂至鼻翼与口角间中点的连线的中1/3段。掌握“面部表面解剖”知识点。